髂内、外动脉分叉处约平对
A. 第4腰椎下缘
B. 骶髂关节
C. 第1腰椎下缘
D. 第3腰椎下缘
E. 无

正确答案：B。骶髂关节

解析：骶髂关节（B对）约平对髂内、外动脉分叉处。